男，14岁，上颌牙龈时常流脓多日。查深龋，探无穿髓孔，松Ⅱ°，叩（±），温测无反应，患牙唇侧根尖处有一瘘管。为明确诊断，需作的检查是
A. 电活力测试
B. 涂片检查
C. 瘘管检查
D. X线片
E. 穿刺

正确答案：D。X线片

解析：本题考查根尖周炎性病变的诊断检查。根据上颌牙龈时常流脓，深龋, 松Ⅱ°，叩（±），温测无反应，患牙唇侧根尖处有一瘘管，可考虑患牙有根尖周炎性病变，为确定诊断，需要拍摄X线片（D对），观察根尖有无骨质破坏，以明确诊断。电活力测试（A错）主要是判断牙髓是否有活力，对于慢性根尖周炎的患牙，牙髓可能有部分活力或者完全丧失活力，在该病例中牙髓是否有活力，并不能作为确诊根尖周炎的依据。涂片检查（B错）是取脓液或溃疡、创面分泌物进行涂片检查，可观察确定分泌物的性质和感染菌种，此操作不能确定诊断。瘘管检查（C错）可以了解瘘管的深度、方向，是否贯通，不能确定瘘管来源，也不能确定诊断。穿刺（E错）是将穿刺针刺入体腔内或肿块内，抽取腔内物质，了解内容物的性质，以协助诊断，本病例中窦道已形成，且牙龈处脓性溢出物明显，故穿刺无意义。